脾主升清的确切内涵是
A. 脾的阳气主升
B. 脾以升为健
C. 脾气散精，上归于肺
D. 与胃的降浊相对而言
E. 输布津液，防止水湿内生

正确答案：C。脾气散精，上归于肺

解析：脾主升清，指脾气升动，将胃肠吸收的水谷精微上输心、肺、头面，通过心、肺的作用化生气血，以营养濡润全身。（C对）。